女，30岁。因反复肾绞痛住院。查体：双肾区叩痛明显。实验室检查：尿红细胞（＋＋），血尿酸及尿尿酸升高，B超示双肾多发结石，双肾轻度积水，KUB（—），该病最常见的病因是
A. 动物蛋白摄入过多
B. 饮酒过量
C. 原发性尿酸代谢障碍
D. 肿瘤溶解综合征
E. 药物抑制尿酸排泄

正确答案：C。原发性尿酸代谢障碍

解析：青年女性，肾结石。肾结石最常见的病因是代谢异常，因此选原发性尿酸代谢障碍（C对）。药物引起的肾结石仅占1%-2%（E错）。